咽喉肿痛，肺痈吐脓，宜用
A. 苦杏仁
B. 竹茹
C. 百部
D. 桔梗
E. 瓜蒌

正确答案：D。桔梗

解析：苦杏仁、百部为止咳平喘药；竹茹、桔梗、瓜蒌为清热化痰药。桔梗苦、辛，平；归肺经。辛散苦泄，开宣肺气，祛痰利咽，为治肺经气分病之要药，治咳嗽痰多，无论寒热皆可应用；能宣肺泄邪以利咽开音疗哑；性散上行，能利肺气以排塞肺之脓痰（D对），治肺痈咳嗽胸痛，咯痰腥臭者，可配甘草用之。